矢状方向上可根据厚度将关节盘分为前、中、后三带，其厚度依次约为
A. 1mm、2mm、3mm
B. 1mm、3mm、2mm
C. 2mm、1mm、3mm
D. 2mm、3mm、1mm
E. 3mm、2mm、1mm

正确答案：C。2mm、1mm、3mm

解析：关节盘位于关节窝、关节结节和髁突之间，呈椭圆形，内外径大于前后径。矢状方向上可根据厚度将关节盘分为前、中、后三带，其厚度依次约为2mm、1mm和3mm。掌握“颞下颌关节的解剖特点”知识点。